属于季节性升高的是
A. 2017年6月台湾省某市某小学和中学共169名学生发生食物中毒
B. 我国北方地区流行性乙型脑炎发病高峰在夏秋季
C. 1965年前我国大中城市人群中麻疹每隔-年流行一次
D. 近年来，猩红热的发病率与死亡率均有明显下降
E. 细菌性痢疾多见于夏秋季

正确答案：E。细菌性痢疾多见于夏秋季

解析：本题考查季节性升高。季节性升高是指一年四季均发病，但仅在一定月份发病率升高，如肠道传染病和呼吸道传染病，全年均有病例发生，但肠道传染病多见于夏秋季，而呼吸道传染病在冬春季高发。细菌性痢疾属于肠道传染病，多见于夏秋季（E对ABCD错）。